有权同意对具有完全民事行为能力且意识清醒的患者实施特殊治疗的人员是
A. 院长
B. 经治医生
C. 科主任
D. 医院伦理委员会主任
E. 患者本人

正确答案：E。患者本人

解析：《医疗机构管理条例》第33条规定，医疗机构施行手术、特殊检查或者特殊治疗时，必须征得患者同意，并应当取得其家属或者关系人同意并签字；无法取得患者意见时，应当取得家属或者关系人同意并签字；无法取得患者意见又无家属或者关系人在场，或者遇到其他特殊情况时，经治医师应当提出医疗处置方案，在取得医疗机构负责人或者被授权负责人员的批准后实施。具有完全民事行为能力且意识清醒的患者依法享有知情同意权，患者本人（E对）有权同意对其实施的特殊治疗。